乙二胺四醋酸二钠滴定液所适用的滴定方法是
A. 酸碱滴定法
B. 非水溶液滴定法
C. 沉淀滴定法
D. 氧化还原滴定法
E. 配位滴定法

正确答案：E。配位滴定法